人类MHC定位于
A. 第7号染色体上
B. 第5号染色体上
C. 第6号染色体上
D. 第13号染色体上
E. 第2号染色体上

正确答案：C。第6号染色体上